从健康传播效果的层次看，以下表述属于知晓健康信息的是
A. 能指出酗酒对健康的危害
B. 经常参加步行、游泳、打太极拳、群众大秧歌舞等健身活动
C. 相信低钠盐有利于健康
D. 反对家人或他人在自己身边吸烟
E. 不能经常吃新鲜的蔬菜、水果

正确答案：A。能指出酗酒对健康的危害